男，62岁。皮肤黄染进行性加重1个月。伴上腹胀、隐痛，食欲差乏力，10天前感皮肤瘙痒，大便呈陶土样。查体：消瘦，巩膜黄染，腹部稍胀，无明显压痛，未触及包块，胆囊无肿大。血AFP5ug/L。最可能的诊断是
A. 肝门部胆管癌
B. 胆囊癌
C. 胆总管下段癌
D. 肝癌
E. 胰头癌

正确答案：A。肝门部胆管癌

解析：老年患者，皮肤瘙痒、皮肤黄染进行性加重（进行性黄疸），大便白陶土样（阻塞性黄疸）。且伴有乏力、消瘦，应首先考虑肿瘤阻塞胆管。患者胆囊无肿大，应属上段胆管癌。最可能的诊断是肝门部胆管癌（A对）。胆囊癌一般不导致阻塞性黄疸（B错）。胆总管下段癌（C错）、胰头癌（E错）一般有胆囊肿大。肝癌（D错）一般AFP≥400μg/L，而本例AFP正常。